瓷全冠属于
A. 金属全冠
B. 非金属全冠
C. 混合全冠
D. 核冠
E. 桩冠

正确答案：B。非金属全冠

解析：本题考查全瓷冠。瓷全冠是以陶瓷材料，即非金属材料（B对）制成的覆盖整个牙冠表面的修复体。金属全冠（A错）是由铸造工艺完成的覆盖整个牙冠表面的金属修复体。混合全冠（C错）是由多种材料制成的全冠修复体，如烤瓷熔附金属全冠。而核冠（D错）和桩冠（E错）均属于桩核冠的一部分，虽可以用全瓷材料制作但不属于全冠。